患儿，10个月。近日来夜寐不安，闻声易惊，汗出浸衣，发稀枕秃，颅骨软化，按之如“乒乓球”状，血钙正常，血磷降低，碱性磷酸酶略高，舌淡﹑苔白，脉软。治疗首选方是
A. 玉屏风散合异功散
B. 益脾镇惊散合牡蛎散
C. 人参五味子汤合玉屏风散
D. 补肾地黄丸合五子衍宗丸
E. 四君子汤合桂枝龙骨牡蛎汤

正确答案：C。人参五味子汤合玉屏风散

解析：该题主要考查小儿维生素D缺乏性佝偻病的辩证以及方药。维生素D缺乏性佝偻病简称佝偻病，是由于儿童体内维生素D不足，致使钙磷代谢失常的一种慢性营养性疾病，以正在生长的骨髓端软骨板不能正常钙化，造成骨骼病变为其特证，肺脾气虚属于初期，以脾虚为本，肌肉松软，大便不实，食欲不振；脾虚及肺，卫外不固，则见多汗、反复感冒；脾虚肝旺，烦躁、夜惊。该患儿，10个月。近日来夜寐不安，闻声易惊，汗出浸衣，发稀枕秃，颅骨软化，按之如“乒乓球”状，血钙正常，血磷降低，碱性磷酸酶略高，舌淡﹑苔白，脉软。可判断为维生素D缺乏性佝偻病肺脾气虚，方药人参五味子汤加减（C对）。益脾镇惊散合牡蛎散治疗脾虚肝旺头部多汗，发稀枕秃，自门迟闭，出牙延迟，坐立行走无力，夜啼不宁，易惊多惕，甚则抽搐，纳呆食少，舌淡苔薄，脉细弦。方药益脾镇惊散加减(B错)。补肾地黄丸合五子衍宗丸治疗肾精亏损,证候有明显的骨骼改变症状，如头颅方大，肋软骨沟，肋串珠，手镯，足镯，鸡胸，漏斗胸等，O型或X型腿，出牙、坐立、行走迟缓，并有面白虚烦，多汗肢软，舌淡苔少，脉细无力。方药补肾地黄丸加减（D错）。四君子汤合桂枝龙骨牡蛎汤未用于治疗维生素D缺乏性佝偻病（E错）。